毒物不引起受试对象出现死亡的最高剂量
A. 绝对致死剂量（LD₁₀₀）
B. 最小致死剂量（LD₀₁）
C. 最大耐受剂量（LD₀）
D. 半数致死剂量（LD₅₀）

正确答案：C。最大耐受剂量（LD₀）

解析：本题考查最大耐受剂量（LD₀）。最大耐受剂量（LD₀）（C对ABD错）指毒物不引起受试对象出现死亡的最高剂量。